分子量较大，能提高血浆胶体渗透压，从而扩充血容量，维持血压的物质是
A. 右旋糖酐
B. 铁剂
C. 维生素K
D. 叶酸
E. 维生素E

正确答案：A。右旋糖酐

解析：右旋糖酐分子量较大，能提高血浆胶体渗透压，从而扩充血容量，维持血压。掌握“维生素K、抗贫血药和右旋糖酐”知识点。